女孩，15岁。下腹疼、坠胀不适5个月。月经规律，末次月经20天前。经腹部B超检查显示子宫大小正常，右侧附件区有一囊实性肿物8cm×8cm×6cm，边界清。血清AFP475ug/L，最可能的诊断是
A. 卵巢无性细胞瘤
B. 卵巢颗粒细胞瘤
C. 卵巢畸胎瘤
D. 卵巢卵黄囊瘤
E. 卵巢浆液性囊腺瘤

正确答案：D。卵巢卵黄囊瘤

解析：青少年女性，月经规律，右侧附件区有一囊性肿物，边界清。血清AFP475ug/L（正常＜20µg/L，明显升高高度提示为卵巢恶性生殖细胞肿瘤），最可能的诊断是卵黄囊瘤（D对）。无性细胞瘤（A错）肿瘤为实性，触之橡皮样（P321）。颗粒细胞瘤（B错）分为成年型颗粒细胞瘤和幼年型颗粒细胞瘤，后者主要发生在青少年，98%为单侧。多数患者在初诊时为早期，肿瘤局限于一侧卵巢，AFP（-）（P321）。浆液性囊腺瘤（E错）多见于中老年妇女，很少发生在青春期前和婴幼儿（P318）。畸胎瘤（C错）多为实性，可见液性囊区。患者AFP正常（P320）。